主要用于敏感细菌所致的尿路感染和伤寒的药物是
A. 美西林
B. 阿度西林
C. 氯唑西林
D. 替卡西林
E. 氨苄西林

正确答案：A。美西林